用人单位和医疗卫生机构发现职业病患者或者疑似职业病患者时，应当及时向哪个部门报告
A. 卫生行政部门
B. 劳动保障行政部门
C. 所在地卫生行政部门
D. 所在地劳动保障行政部门
E. 省级以上卫生行政部门

正确答案：C。所在地卫生行政部门